影响H⁺，K⁺-ATP酶活性的药物是
A. 间羟胺
B. 维拉帕米
C. 氟尿嘧啶
D. 奥美拉唑
E. 异丙肾上腺素

正确答案：D。奥美拉唑

解析：本题考查奥美拉唑。奥美拉唑（D对）属于质子泵抑制剂，通过抑制质子泵（H⁺，K⁺-ATP酶）的活性来抑制胃酸的分泌；间羟胺（A错）为α受体激动剂，有中等加强心脏收缩的作用，用于各种休克及手术时低血压；维拉帕米（B错）为钙离子通道阻滞剂，属Ⅳ类抗心律失常药；氟尿嘧啶（C错）为常用的肿瘤治疗药物；异丙肾上腺素（E错）为β受体激动剂，临床用于支气管哮喘、房室传导阻滞等。